可能会导致便秘的药品是
A. 吗啡
B. 木糖醇
C. 乳酶生
D. 硫酸镁
E. 乳果糖

正确答案：A。吗啡

解析：本题考查吗啡。吗啡（A对）为阿片类镇痛药，可通过激动μ₂受体松弛胃肠道平滑肌，导致便秘；木糖醇（B错）在体内新陈代谢不需要胰岛素参与，也不使血糖值升高，是糖尿病人安全的甜味剂、营养补充剂和辅助治疗剂；乳酶生（C错）为活肠球菌的干燥制剂，适用于治疗消化不良，肠内异常发酵，小儿腹泻及小儿便秘等；硫酸镁（D错）口服具有利胆、导泻和消肿的作用；乳果糖（E错）能够治疗便秘，糖尿病患者慎用，有乳酸血症患者禁用。